公共场所直接为顾客服务的人员，患有下列疾病治愈前不得从事直接为顾客服务的工作，但除外
A. 痢疾
B. 伤寒
C. 病毒性肝炎
D. 活动期肺结核
E. 关节炎

正确答案：E。关节炎